冠状动脉粥样硬化最常发生的部位是
A. 左冠状动脉主干
B. 左冠状动脉前降支
C. 左冠状动脉左旋支
D. 右冠状动脉主干
E. 右冠状动脉后降支

正确答案：B。左冠状动脉前降支

解析：冠状动脉粥样硬化的发生部位，以左冠状动脉前降支为最高（B对），其余依次为右冠状动脉主干（D错）、左冠状动脉主干（A错）或左冠状动脉左旋支（C错）、右冠状动脉后降支（E错）。